健康期望寿命是
A. PYLL
B. LEFD
C. ALE
D. DALY
E. HALE

正确答案：E。HALE